蛋白质腐败作用的主要产物
A. 胺类
B. 酚类
C. 吲哚
D. 硫化氢
E. 以上都是

正确答案：E。以上都是

解析：未被吸收的氨基酸及未被消化的蛋白质，在大肠下部受大肠杆菌的作用。这种作用称为蛋白质的腐败作用。腐败作用的产物中有些是有一定的营养意义的。一般认为人类维生素K的供应，主要得自大肠杆菌。其他大多数腐败作用产物，对人类是有害的。这些有害的产物主要有胺类、酚类，吲哚及硫化氢等。掌握“蛋白质生理作用及消化”知识点。